药品经营企业中，实行双人双锁管理制度的药品是
A. 麻醉药品
B. 计划生育类药品
C. 毒性药品
D. 二类精神药品
E. 放射性药品

正确答案：A、C、E。麻醉药品；毒性药品；放射性药品

解析：本题考查双人双锁管理制度。药品经营企业中，实行双人双锁管理制度的药品是麻醉药品（A对）、毒性药品（C对）、放射性药品（E对）。麻醉药品和第一类精神药品（D错）入出库实行双人核查制度，药品入库须双人验收，出库须双人复核，做到账、物相符。毒性药品的储存管理要求与麻醉药品的储存管理要求基本相同，储存毒性药品的专库或专柜加锁并由专人保管，做到双人双锁管理，专账记录。根据《放射性药品管理办法》，放射性药品应严格实行专库（柜）、双人双锁保管，专账记录。计划生育类药品（B错）无特殊要求。